尖锐湿疣的病原体是
A. 人乳头瘤病毒
B. 苍白密螺旋体
C. 单纯疱疹病毒
D. 革兰阴性双球菌
E. 钩端螺旋体

正确答案：A。人乳头瘤病毒

解析：尖锐湿疣的病原体是人乳头瘤状病毒（HPV）（A对）的低危性HPV（6型、11型等），高危型HPV（16型、18型等）与子宫颈癌等恶性肿瘤的发生密切相关。苍白密螺旋体（B错）俗称梅毒螺旋体，是人类梅毒病原体（P202）。单纯疱疹病毒（HSV）（C错）可致导致口、唇、生殖器疱疹等多种疾病，如龈口炎、角膜结膜炎、新生儿感染（P295-P296）。